儿童长期服用糖皮质激素，可能导致骨质疏松症以外的不良反应是
A. 婴儿生长发育抑制
B. 血压升高
C. 胎盘功能不全
D. 支气管哮喘
E. 儿童生长发育抑制

正确答案：E。儿童生长发育抑制

解析：本题考查糖皮质激素的使用。儿童长期服用糖皮质激素，可能导致骨质疏松症以外的不良反应是儿童生长发育抑制（E对）。儿童长期使用糖皮质激素可能造成生长迟缓和肾上腺皮质功能受抑制。婴儿生长发育抑制（A错）是哺乳期妇女使用糖皮质激素的不良反应。血压升高（B错）是老年人使用糖皮质激素的不良反应。胎盘功能不全（C错）是妊娠妇女使用糖皮质激素的不良反应。支气管哮喘（D错）是糖皮质激素的适应证。